治疗放线菌的首选用药
A. 链霉素
B. 红霉素
C. 青霉素
D. 甲硝唑
E. 万古霉素

正确答案：C。青霉素

解析：本题考查牙周病的药物治疗。治疗放线菌的首选用药是青霉素。该类药物属于β-内酰胺类抗生素。牙周治疗中最常用的青霉素类药物为羟氨苄青霉素，又名阿莫西林，是半合成的广谱青霉素，对G⁺菌及部分G⁻菌有强力杀菌作用。该药与甲硝唑联合使用治疗侵袭性牙用炎，可增强疗效。